治疗消渴时，属脾胃气虚者，宜选用的中成药是
A. 补肾强身片
B. 杞菊地黄丸
C. 金芪降糖片
D. 消渴平片
E. 参苓白术丸

正确答案：E。参苓白术丸

解析：本题考查的是消渴的辨证论治。治疗消渴时，属脾胃气虚者，宜选用的中成药是参苓白术丸（E对）。消渴是以多饮、多食、多尿、乏力、消瘦，或尿有甜味为主要临床表现的疾病。（一）阴虚燥热证：【中成药应用】常用中成药有降糖胶囊、消渴平片（D错）、消糖灵胶囊。（二）脾胃气虚证：【中成药应用】常用中成药有参苓白术散、益津降糖口服液。（三）气阴两虚证：【中成药应用】常用中成药有参精止渴丸、参芪降糖胶囊、消渴丸。（四）肾阴亏虚证：【中成药应用】常用中成药有六味地黄丸（水蜜丸）、麦味地黄丸（水蜜丸）。（五）阴阳两虚证：【中成药应用】常用中成药有金匮肾气丸。补肾强身丸（A错）具有阴阳双补作用，男性不育症临床上可酌情选用。补肾强身丸：【功能】补肾强身。【主治】用于腰酸足软，头晕耳鸣，眼花心悸。中成药应用为杞菊地黄丸（B错）或金芪降糖片（C错）的病证，2022年考试指南未明确说明。